某男，60岁。患慢性肾功能衰竭5年，症见少气乏力、腰膝酸软、恶心呕吐、肢体浮肿、面色萎黄，证属脾肾亏损、湿浊内停、瘀血阻滞，宜选用的成药是
A. 舟车丸
B. 尿毒清颗粒
C. 癃清片
D. 肾炎康复片
E. 防风通圣丸

正确答案：B。尿毒清颗粒

解析：本题考查的是尿毒清颗粒的主治。某男，60岁。患慢性肾功能衰竭5年，症见少气乏力、腰膝酸软、恶心呕吐、肢体浮肿、面色萎黄，证属脾肾亏损、湿浊内停、瘀血阻滞，宜选用的成药是尿毒清颗粒（B对）。尿毒清颗粒：【主治】脾肾亏损，湿浊内停，瘀血阻滞所致的少气乏力、腰膝酸软、恶心呕吐、肢体浮肿、面色萎黄；以及慢性肾功能衰竭（氮质血症期或尿毒症早期）见上述证候者。舟车丸（A错）：【主治】水停气滞所致的水肿，症见蓄水腹胀、四肢浮肿、胸腹胀满、停饮喘急、大便秘结、小便短少。癃清片（C错）：【主治】下焦湿热所致的热淋，症见尿频、尿急、尿痛、腰痛、小腹坠胀。亦用于慢性前列腺炎之湿热蕴结兼瘀血证，症见小便频急，尿后余沥不尽，尿道灼热，会阴少腹腰骶部疼痛或不适等。肾炎康复片（D错）：【主治】气阴两虚，脾肾不足，水湿内停所致的体虚浮肿，症见神疲乏力、腰膝酸软、面目四肢浮肿、头晕耳鸣；慢性肾炎、蛋白尿、血尿见上述证候者。防风通圣丸（E错）：【主治】外寒内热，表里俱实，恶寒壮热，头痛咽干，小便短赤，大便秘结，瘰疬初起，风疹湿疮。